细辛主治的病证是
A. 蛔虫腹痛、吐蛔
B. 气血虚衰症
C. 肾阳不足阳痿
D. 肝肾不足眩晕
E. 寒饮伏肺咳喘

正确答案：E。寒饮伏肺咳喘

解析：本题考查的是细辛的主治病证。细辛主治的病证是寒饮伏肺咳喘（E对）。细辛：【主治病证】（1）风寒表证（尤宜鼻塞、头痛、肢体疼痛较甚者），阳虚外感。（2）鼻渊头痛。（3）头风头痛，牙痛，风寒湿痹痛。（4）寒饮咳喘。花椒：【主治病证】（1）脘腹冷痛，中寒呕吐、泄泻。（2）虫积腹痛，蛔虫、蛲虫所致者尤宜（A错）。（3）湿疹，阴痒。黄芪：【主治病证】（1）脾胃气虚，脾肺气虚，中气下陷，气不摄血，气虚发热。（2）自汗，盗汗。（3）气血不足所致的疮痈不溃或溃久不敛（B错）。（4）气虚水肿、小便不利。（5）气血双亏，血虚萎黄，血痹肢麻，半身不遂，消渴。附子：【主治病证】（1）亡阳欲脱。（2）肾阳不足、命门火衰之畏寒肢冷、阳痿（C错）、宫冷、尿频。（3）脾肾阳虚之脘腹冷痛、泄泻、水肿。（4）心阳虚衰之心悸、胸痹。（5）寒湿痹痛，阳虚外感。主治病证为肝肾不足眩晕（D错）的中药，2022年考试指南未明确说明。